关于维拉帕米结构特征和作用的说法，错误的是
A. 属于芳烷基胺类的钙通道阻滞剂
B. 含有甲胺结构，易发生N-脱甲基化代谢
C. 具有碱性，易被强酸分解
D. 结构中含有手性碳原子，现仍用外消旋体
E. 通常口服给药，易被吸收

正确答案：C。具有碱性，易被强酸分解

解析：本题考查维拉帕米。维拉帕米呈弱碱性，pKₐ=8.6，化学稳定性良好，在热、光化学降解条件下，以及酸、碱溶液中稳定性都很好（C错，为本题正确答案）；维拉帕米属于芳烷基胺类的钙通道阻滞剂（A对），口服吸收（E对）后，经肝脏代谢，代谢物主要为N-脱甲基化合物，即去甲维拉帕米（B对），生物利用度为20%；分子中含有手性碳原子，右旋比左旋体的作用强的多，现用外旋体（D对）。